具有成骨、修复和改建功能的部分是
A. 骨松质
B. 骨密质
C. 骨外膜的内层和骨内膜
D. 骨外膜的外层
E. 红骨髓

正确答案：C。骨外膜的内层和骨内膜

解析：具有成骨、修复和改建功能的部分是骨外膜的内层和骨内膜（C对）。